某女，50岁。心悸怔忡，失眠多梦，健忘，食少便溏，倦怠乏力；舌淡嫩，脉细弱。辨析其证候是
A. 心脾两虚
B. 心气虚
C. 心肺气虚
D. 心血虚
E. 心肾不交

正确答案：A。心脾两虚

解析：本题考查心脾两虚证的临床表现及辨证要点。辨析其证候是心脾两虚（A对）。心脾两虚证的临床表现及辨证要点：心脾两虚证的临床表现，常见心悸怔忡，失眠多梦，健忘，食纳减少，腹胀，大便溏泻，倦怠乏力，舌质淡嫩，脉细弱。心气虚（B错）证与心阳虚证的临床表现及辨证要点：心阳虚与心气虚的共有症状是：心悸，气短，自汗，活动或劳累后加重。心气虚证的临床表现，除上述共有症状外，兼见面色白、体倦乏力、舌质淡、舌体胖嫩、苔白、脉虚。肺气虚（C错）证的临床表现及辨证要点：肺气虚证的临床表现，常见咳喘无力，气短懒言，声音低微，或语言断续无力，稍一用力则气吁而喘，周身乏力，自汗出，面色白，舌质淡嫩，脉虚弱等。一般以咳喘无力、气少不足以息和全身功能活动减弱为辨证要点。心血虚（D错）证与心阴虚证的临床表现及辨证要点：心血虚与心阴虚的共同症状是：心悸，心烦，易惊，失眠，健忘。心血虚证的临床表现，除上述症状外，兼见眩晕、面色不华、唇舌色淡、脉细弱。心肾不交（E错）证的临床表现及辨证要点：心肾不交证的临床表现，常见虚烦失眠，心悸健忘，头晕耳鸣，咽干，腰膝酸软，多梦遗精，潮热盗汗，小便短赤，舌红无苔，脉细数。心阴虚，神失所养，故见虚烦失眠、心悸健忘。肾阴虚，则腰膝酸软。肾之阴精不足，不能上养清窍，故见头晕耳鸣。虚火内扰、精关不固，则多梦遗精。潮热盗汗、咽干、小便短赤、舌红无苔、脉细数，均属阴虚内热之象。一般以失眠，伴见心火亢而肾水虚的症状为辨证要点。